病例与对照配比的因素必须是
A. 可疑的混淆因子
B. 可疑的暴露因子
C. 未知的混淆因子
D. 未知的暴露因子
E. 已知的混淆因子或至少有充分理由怀疑的混淆因子

正确答案：E。已知的混淆因子或至少有充分理由怀疑的混淆因子